若病人意识清醒，但角膜反射消失，损伤可能在
A. 视神经或动眼神经
B. 视神经或三叉神经
C. 动眼神经或三叉神经
D. 三叉神经或面神经
E. 动眼神经或面神经

正确答案：D。三叉神经或面神经

解析：一侧三叉神经损伤、面神经（D对）管外损伤均可导致角膜反射消失。一侧动眼神经损伤，可致同侧上脸提肌、上直肌、内直肌、下直肌、下斜肌瘫痪；并伴上脸下垂、瞳孔斜向外下方及瞳孔扩大，对光反射消失等症状（ACE错）。